砷中毒首选的特效解毒剂是
A. 维生素C
B. 二巯基丙醇
C. 亚甲蓝
D. 二巯基丙磺酸钠
E. 维生素E

正确答案：D。二巯基丙磺酸钠